关于辛伐他汀性质的说法，正确的有
A. 辛伐他汀是由洛伐他汀结构改造而得的药物
B. 辛伐他汀是前体药物
C. 辛伐他汀是HMG-CoA还原酶抑制剂
D. 辛伐他汀是通过全合成得到的药物
E. 辛伐他汀是水溶性药物

正确答案：A、B、C。辛伐他汀是由洛伐他汀结构改造而得的药物；辛伐他汀是前体药物；辛伐他汀是HMG-CoA还原酶抑制剂

解析：本题考查他汀类药物。辛伐他汀是由洛伐他汀结构改造而得的药物（A对D错），属于前体药物（B对）。辛伐他汀属于HMG-CoA还原酶抑制剂（C对），借此抑制肝脏制造胆固醇。辛伐他汀为脂溶性药物，在水中不溶（E错）。